在夏季使用农药季节，某施药工感到头晕，化验胆碱酯酶活性正常，可疑何种毒物中毒
A. 有机磷农药中毒
B. 氨基甲酸酯类农药中毒
C. 乐果中毒
D. 对硫磷中毒
E. 拟除虫菊酯类农药中毒

正确答案：E。拟除虫菊酯类农药中毒